3岁女孩，反复咳嗽2个月，查体：体温正常，浅表淋巴结（-），咽（-），两肺多哮鸣音，无水泡音，反复抗生素治疗不愈，以往无呛咳病史，有过敏性鼻炎。如病情恶化，呼吸音减弱，应紧急采用
A. 纯氧吸入
B. 机械通气
C. 胸外按压
D. 头部冰枕
E. 水合氯醛灌肠

正确答案：B。机械通气

解析：3岁女孩，反复咳嗽2个月，查体：体温正常，浅表淋巴结（-），咽（-），两肺多哮鸣音，无水泡音，反复抗生素治疗不愈，以往无呛咳病史，有过敏性鼻炎等表现符合咳嗽变异型哮喘的诊断标准，如病情恶化，呼吸音减弱，即药物治疗无效，符合辅助机械通气指征，此时应紧急采用机械通气（B对），以改善缺氧症状。纯氧吸入（A错）可用于缺氧状态下但通气功能基本正常，胸外按摩（C错）是指发生心跳骤停时，借助外力挤压心脏和胸腔排送血液，以形成暂时的人工循环的方法，以便争取到更完善的复苏条件，提高病人成活的可能性。头部冰枕（D错）是常用的物理降温方法之一，利用局部的冰敷达到降低头部温度的作用。水合氯醛灌肠（E错）常用于做催眠药和抗惊厥药等，经直肠给药可迅速吸收。